更年期综合征的主要症状不包括
A. 血管舒缩症状
B. 绝经后骨质疏松
C. 神经精神症状
D. 月经紊乱
E. 心血管症状

正确答案：B。绝经后骨质疏松

解析：本题考查更年期综合征的主要症状。绝经后骨质疏松（B错，为本题正确答案）不属于更年期综合征的主要症状，是危害中老年妇女健康的和影响生活质量的重大疾病。更年期综合是指由于卵巢功能减退，雌激素减少或缺乏而引起的以月经改变、自主神经功能紊乱为主要症状，同时伴有心理、神经精神及骨骼肌肉等一组症候群。主要症状包括：血管舒缩症状（A对）、神经精神症状（C对）、月经紊乱（D对）、心血管症状（E对）、骨关节肌肉症状、其他如皮肤蚁走感等症状。